窝沟封闭乳磨牙宜在
A. 2~3岁
B. 3~4岁
C. 6~7岁
D. 10~11岁
E. 12~13岁

正确答案：B。3~4岁